不含咪唑环的抗真菌药物是
A. 酮康唑
B. 克霉唑
C. 伊曲康唑
D. 咪康唑
E. 噻康唑

正确答案：C。伊曲康唑

解析：本题考查抗真菌药。伊曲康唑（C对）为三氮唑类抗真菌药物，含三氮唑，不含咪唑环。酮康唑（A错）、克霉唑（B错）、咪康唑（D错）和噻康唑（E错）均含咪唑环。